男，67岁。头痛、呕吐数天。4个月前有头部摔伤史。头颅CT示右额颞顶新月形中等密度影。该患者最可能的诊断是
A. 脑挫伤
B. 脑肿瘤
C. 慢性硬膜外血肿
D. 脑转移瘤
E. 慢性硬膜下血肿

正确答案：E。慢性硬膜下血肿

解析：老年男性患者，头痛、呕吐数天（颅内压增高的表现），有头部外伤史，头颅CT示右额颞顶新月形中等密度（慢性硬膜下血肿的典型表现），结合患者病史、临床表现和影像学表现，最可能的诊断为右额颞顶慢性硬膜下血肿（E对）。脑挫伤（P188）（A错）多表现为伤后立即出现的意识障碍，CT表现为局部脑组织内高低密度混杂影。脑肿瘤（P198）（B错）以颅内压增高和神经功能定位体征为主要表现，CT多表现为脑组织内不规则的低密度或等密度影，可见瘤周水肿。慢性硬膜外血肿（C错）较少见，CT表现为颅骨内板与硬脑膜之间双凸镜形或弓形低密度影。脑转移瘤（D错）CT多表现为脑组织内多发的圆形等密度或低密度影，瘤周水肿严重。